《药品生产质量管理规范附录》规定，口服固体药品的暴露工序要求的洁净区洁净级别应为
A. 100级
B. 1000级
C. 10000级
D. 100000级
E. 300000级

正确答案：E。300000级